男孩，1岁半。平日偏食，常有腹泻咳嗽，已会独立行走，玩耍正常。近2个月来面色苍黄，逗之不笑，时有头部肢体颤抖，不能独站。外周血象：血红蛋白100g/L，红细胞2.5×10¹²/L，白细胞数4×10⁹/L，中性粒细胞分叶过多。本例可诊断为
A. 营养不良伴低钙血症
B. 慢性腹泻伴低钙血症
C. 缺铁性贫血伴低钙血症
D. 营养性巨幼红细胞贫血
E. 营养性缺铁性贫血

正确答案：D。营养性巨幼红细胞贫血

解析：患儿面色苍黄、头部肢体颤抖、不能独站且血红蛋白100g/L应诊断为营养性巨幼红细胞贫血（D对）。重度低钙血症会出现手足的颤抖但不是头部肢体颤抖，因此不符合各种疾病所伴发的低钙血症的判断（ABC错）。营养性缺铁性贫血面色一般是苍白的而不是苍黄，虽然有少部分营养性缺铁性贫血也会出现精神神经系统方面的症状，但很少会出现肢体的颤抖（E错）。